作用于远曲小管和集合管的利尿药是
A. 氨苯蝶啶
B. 吲达帕胺
C. 呋塞米
D. 氢氯噻嗪
E. 氯噻酮

正确答案：A。氨苯蝶啶

解析：本题考查利尿药的作用机制。作用于远曲小管和集合管的利尿药是氨苯蝶啶（A对）。氨苯蝶啶是肾小管上皮细胞Na⁺通道阻滞剂，作用于远曲小管和集合管。吲达帕胺（B错）通过抑制肾皮质稀释段对钠的重吸收达到利尿效果。呋塞米（C错）作用于肾脏、肾小管、髓袢升支粗段上面的钠钾二氯泵。氢氯噻嗪（D错）作用于髓袢皮质部，抑制NaCl的再吸收。氯噻酮（E错）主要抑制远端小管前段和近端小管对NaCl的重吸收。